中毒性肾病主要见于（）中毒
A. 镉
B. 氟
C. 苯
D. 黄磷
E. 四氯化碳

正确答案：A。镉